延伸卡环适用于
A. 孤立牙
B. 远中孤立的磨牙
C. 相邻两牙间有间隙者
D. 倾斜基牙
E. 松动或牙冠外形差的基牙

正确答案：E。松动或牙冠外形差的基牙

解析：延伸卡环：用于松动或牙冠外形差的基牙，将卡环臂延伸到邻近牙齿的倒凹区以获得固位和夹板固定作用。掌握“局部义齿固位体”知识点。